涂料在使用过程中产生的什么成分可能是引起机体过敏的主要原因
A. 漆酚
B. VOCs
C. 铅
D. 铬
E. 镉

正确答案：A。漆酚

解析：本题考查涂料中引起机体过敏的成分。涂料在使用过程中产生漆酚（A对BCDE错）可能是引起机体过敏的主要原因。漆酚毒性很大，常会导致机体过敏，引起变应性皮炎。